女性，42岁，2个月来，情绪低落，兴趣索然，自觉“高兴不起来”，生不如死，“自己的脑子不灵了”，“像是生了锈的机器”，认为自己成了家庭和社会的累赘，“成了废物”，有胸闷、心悸、心慌的症状，自认为有严重心脏病，不能治愈。主动性言语及活动明显减少，生活被动，愿独处。曾多次自杀未遂，睡眠不好，早醒。该病人首要注意的问题是防止
A. 活动少而引起的合并感染
B. 拒食导致营养不良
C. 自杀行为
D. 冲动伤人
E. 症状波动的规律

正确答案：C。自杀行为

解析：中年女性，2个月来，情绪低落，兴趣索然，自觉“高兴不起来”，生不如死，“自己的脑子不灵了”，“像是生了锈的机器”（典型的思维迟缓的症状），认为自己成了家庭和社会的累赘，“成了废物”（典型的自责自罪症状），有胸闷、心悸、心慌的症状，自认为有严重心脏病，不能治愈（典型疑病观念）。主动性言语及活动明显减少，生活被动，愿独处（典型的意志活动减低的症状）。曾多次自杀未遂（提示有自杀企图），睡眠不好，早醒，根据患者的临床症状，考虑最可能的诊断为抑郁症，且该患者有明显的自杀倾向，所以该病人首要注意的问题是防止自杀行为（C对）。